海鱼中具有预防心血管疾病作用的主要成分是
A. 多不饱和脂肪酸
B. 碘
C. 优质蛋白
D. 维生素A
E. 维生素C

正确答案：A。多不饱和脂肪酸

解析：本题考查海鱼中具有预防心血管疾病作用的主要成分。一些深海鱼类脂肪含长链多不饱和脂肪酸高（A对BCDE错），具有预防心血管疾病的作用。